能敛肺，涩肠，止痛的药是
A. 五倍子
B. 五味子
C. 乌梅
D. 诃子
E. 罂粟壳

正确答案：E。罂粟壳

解析：本题考查的是罂粟壳的功效。能敛肺，涩肠，止痛的药是罂粟壳（E对）。罂粟壳：【功效】敛肺，涩肠，止痛。五倍子（A错）：【功效】敛肺降火，涩肠固精，敛汗止血，收湿敛疮。五味子（B错）：【功效】收敛固涩，益气生津，滋肾宁心。乌梅（C错）：【功效】敛肺，涩肠，生津，安蛔，止血。诃子（D错）：【功效】涩肠，敛肺，下气，利咽。